突发公共卫生事件是指下列哪类突然发生，造成或者可能造成社会公众健康损害的事件
A. 甲类或乙类传染病流行
B. 重大传染病疫情、群体性不明原因疾病、重大食物和职业中毒以及其他严重影响公众健康的事件
C. 环境污染
D. 寄生虫病疫情
E. 水灾、地震等严重危害公众生命财产安全的自然灾害

正确答案：B。重大传染病疫情、群体性不明原因疾病、重大食物和职业中毒以及其他严重影响公众健康的事件

解析：在我国《突发公共卫生事件应急条例》中，所谓突发公共卫生事件是指突然发生，造成或者可能造成社会公众健康严重损害的重大传染病疫情、群体性不明原因疾病、重大食物和职业中毒以及其他严重影响公众健康的事件。掌握“公共卫生工作伦理要求”知识点。